关于密质骨的分布，下列说法错误的是
A. 密质骨是颌骨内、外骨板延伸的部分
B. 表面为平行骨板，深部有不同厚度的哈弗系统
C. 上颌前牙区唇面牙槽骨很薄
D. 下颌前牙区舌侧骨板比颊侧厚
E. 下颌磨牙区颊侧密质骨很薄

正确答案：E。下颌磨牙区颊侧密质骨很薄

解析：密质骨是牙槽骨的外表部分，即颌骨内、外骨板延伸的部分。密质骨表面为平行骨板，深部有致密的不同厚度的哈弗系统的骨。密质骨在上颌前牙区很薄，下颌的密质骨，在磨牙区颊侧骨板也增厚。掌握“牙槽骨”知识点。